引起津液不足的原因有
A. 发热
B. 多汗
C. 吐泻
D. 失血
E. 多尿

正确答案：A、B、C、D、E。发热；多汗；吐泻；失血；多尿

解析：本题考查的是引起津液不足的原因。引起津液不足的原因有发热（A对）、多汗（B对）、吐泻（C对）、失血（D对）与多尿（E对）。津液不足，是指津液在数量上的亏少，进而导致内则脏腑，外而孔窍、皮毛，失其濡润滋养作用，因之产生一系列干燥失润的病机变化。多由燥热之邪或五志之火，或发热、多汗、吐泻、多尿、失血，或过用误用辛燥之剂等引起津液耗伤所致。常见口、鼻、皮肤干燥，大吐、大泻、多尿时所出现的目陷、螺瘪，甚则转筋等；热病后期或久病伤阴，所见到的舌光红无苔或少苔、唇舌干燥而不引饮、形瘦肉脱、肌肤毛发枯槁，甚则肌肉、手足震颤蠕动等临床表现。